二尖瓣关闭不全
A. 第一心音增强
B. 心率小于脉率
C. 心室律绝对不规则
D. 心尖部3/6级收缩期杂音
E. 开瓣音

正确答案：D。心尖部3/6级收缩期杂音

解析：二尖瓣关闭不全时，收缩期左心室内血液通过关闭不全的瓣膜口反流进入左心房，形成心尖部3/6级收缩期杂音（D对）。第一心音增强（A错）常见于二尖瓣狭窄。心率大于脉率（脉搏短绌）（B错）和心室律绝对不规则（C错）都是房颤的典型体征（P188）。开瓣音（九版诊断学P153）（E错）又称二尖瓣开放拍击声，见于二尖瓣狭窄而瓣膜尚柔软时。